糖皮质激素类药物的禁忌证包括
A. 肾病综合征
B. 活动性消化性溃疡
C. 类风湿性关节炎
D. 未能控制的真菌感染
E. 股骨头坏死

正确答案：B、D、E。活动性消化性溃疡；未能控制的真菌感染；股骨头坏死

解析：本题考查使用糖皮质激素的禁忌证。糖皮质激素的禁忌证：①严重精神病或癫痫病史者、活动性消化性溃疡病（B对）或新近胃肠吻合术者、骨折患者（E对）、创伤修复期患者、角膜溃疡者、肾上腺皮质功能亢进者、严重高血压、糖尿病患者。②妊娠早期妇女。③抗菌药物不能控制的水痘、真菌感染者。④未能控制的结核、细菌和病毒感染者（D对）。肾病综合征（A错）和类风湿性关节炎（C错）是糖皮质激素的适应证。